精脒、精胺的前体是
A. 鸟氨酸
B. 谷氨酸
C. 组氨酸
D. 色氨酸
E. 苏氨酸

正确答案：A。鸟氨酸